女，35岁。确诊系统性红斑狼疮，经泼尼松50mg/d治疗后1个月病情稳定，随后激素逐渐减量，至泼尼松25mg/d时出现发热，体温38.4℃。不能反应狼疮活动性的指标是
A. 血沉
B. 补体
C. 抗双链DNA抗体
D. 血培养
E. 血常规

正确答案：D。血培养

解析：患者于糖皮质激素减量过程中出现发热，最可能的原因是狼疮活动。血沉（A对）加快、补体（B对）减少、抗双链DNA抗体（C对）滴度增高、血常规（E对）示血小板计数减少均提示狼疮活动。血培养（D错，为本题正确答案）多用于诊断败血症，对诊断狼疮活动无意义。